熟地黄的功效是
A. 补血养阴，填精益髓
B. 补肝肾，益精血
C. 补益心脾，养血安神
D. 补脾养胃，生津益肺
E. 清热凉血，养阴生津

正确答案：A。补血养阴，填精益髓

解析：熟地黄味甘、性微温，入肝、肾经，其功效为补血滋阴，益精填髓（A对）。甘温质润滋腻，入肝经血分，守而不走，专能补血。入肾，能滋肾益阴，补精生髓，以培补下元而固本。